应当具备药学中专或者医学、生物、化学等相关专业大学专科以上学历或者具有药学初级以上专业技术职称的是
A. 质量管理工作人员
B. 养护工作人员
C. 药品采购工作人员
D. 药品销售人员

正确答案：A。质量管理工作人员

解析：本题考查药品批发企业经营和质量管理人员的资质要求。质量管理工作人员（A对）要求具有药学中专或者医学、生物、化学等相关专业大学专科以上学历或者具有药学初级以上专业技术职称。